病例对照研究中，下列哪种匹配效率最高
A. 1：1匹配
B. 1：2匹配
C. 1：3匹配
D. 1：4匹配
E. 1：5匹配

正确答案：D。1：4匹配